运动员在运动前用餐选择的食物应
A. 体积大，易消化吸收
B. 体积小，不易消化吸收
C. 能量密度低，易消化吸收
D. 以动物性食物为主
E. 以谷类食物为主

正确答案：E。以谷类食物为主

解析：本题考查运动员在运动前用餐食物的选择。运动员在运动前用餐应选择浓缩、体积小（A错）、重量轻、能量密度高而且易消化吸收的食物（BC错）。应该以谷类食物为主（E对），动物性食物为辅（D错），特别要保证碳水化合物供给。